慢性疼痛尤其是癫痫患者的镇痛治疗宜辅助使用
A. 解热镇痛抗炎药
B. 阿片类镇痛药
C. 糖皮质激素
D. 抗癫痫药
E. 抗抑郁药

正确答案：D。抗癫痫药

解析：本题考查药物镇静。慢性疼痛尤其是癫痫患者的镇痛治疗宜辅助使用抗癫痫药（D对）。解热镇痛药有周围性镇痛作用，对于炎症、组织损伤引起的疼痛尤为有效，有抗炎抗风湿作用（A错）；阿片类镇痛药有中枢性镇痛作用，用于癌症患者、创伤或术后镇痛（B错）；糖皮质激素类药主要起抗炎和免疫抑制作用（C错）；抗癫痫药是治疗三叉神经痛的常用镇痛药物，可辅助治疗慢性疼痛；三环类抗抑郁药可用于辅助治疗癌症患者的慢性疼痛，也可降低惊厥发作阈，引起癫痫发作（E错）。